除另有规定外，口服制剂标签应注明“用前摇匀”的是
A. 溶液剂
B. 混悬剂
C. 乳剂
D. 糖浆剂
E. 合剂

正确答案：B。混悬剂

解析：本题考查的是液体制剂生产与贮藏的有关规定。除另有规定外，口服制剂标签应注明“用前摇匀”的是混悬剂（B对）。混悬剂系指难溶性固体药物以微粒状态分散于分散介质中形成的非均相的液体制剂。口服混悬剂的应分散均匀，放置后若有沉淀物，经振摇应易再分散。口服混悬剂在标签上应注明“用前摇匀”。溶液剂（A错）系指药物溶解于溶剂中形成的澄明液体制剂。乳剂（C错）系指两种互不相溶的液体，经乳化制成的一种液体以液滴状态分散于另一相液体中形成的非均相分散体系的液体制剂。口服乳剂的外观应呈均匀的乳白色，以半径为10cm的离心机每分钟4000转的转速离心15分钟，不应有分层现象。乳剂可能会出现相分离的现象，但经振摇应易再分散。糖浆剂（D错）系指含有原料药物的浓蔗糖水溶液。糖浆剂应澄清，在贮存期间不得有发霉、酸败、产生气体或其他变质现象，允许有少量摇之易散的沉淀。合剂（E错）系指中药饮片用水或其他溶剂，采用适宜的方法提取、制成的口服液体制剂，其中单剂量灌装者也可称为口服液。除另有规定外，合剂应澄清。在贮存期间不得有发霉、酸败、异物、变色、产生气体或其他变质现象，允许有少量摇之易散的沉淀。